正确描述颏舌肌的是
A. 是成对的舌内肌
B. 起于下颌骨的颏
C. 止于舌的两侧
D. 两侧收缩时，可拉舌向前下
E. 单侧收缩时，使舌尖伸向同侧

正确答案：D。两侧收缩时，可拉舌向前下

解析：颏舌肌为成对的舌外肌(A错)，起于下颌体后的颏棘(B错)，止于舌正中线两侧(C错)，两侧收缩时可拉舌向前下(D对)，单侧收缩时使舌尖伸向对侧(E错)。